以下关于引起局限性的麻木、感觉障碍最佳的选项是
A. 维生素B₁缺乏
B. 神经官能症
C. 三叉神经炎
D. 手术引起
E. 以上均是

正确答案：E。以上均是

解析：局限性的麻木、感觉障碍也可能由于维生素B₁缺乏、神经官能症、三叉神经炎、注射无水乙醇或手术后所引起，根据病史不难确定。掌握“三叉神经痛”知识点。